为了预防地方性甲状腺肿，让整个研究地区的人群食用加碘食盐，这种方法属于
A. 随机对照试验
B. 现场试验
C. 社区试验
D. 病例报告
E. 类试验

正确答案：C。社区试验

解析：本题考查实验流行病学中的社区试验。社区试验是以人群作为整体进行试验观察，常用于对某种预防措施或方法进行考核或评价。本题中让整个研究地区的人群食用加碘食盐，这种方法属于社区试验（C对ABDE错）。